宜与蛤蚧同贮的是
A. 牡丹皮
B. 细辛
C. 红花
D. 灯心草
E. 吴茱萸

正确答案：E。吴茱萸

解析：本题考查的是对抗贮存法。宜与蛤蚧同贮的是吴茱萸（E对）。对抗贮存法也称异性对抗驱虫养护，是采用两种或两种以上药物同贮，相互克制，起到防止虫蛀、霉变作用的养护方法。一般适用于数量不多的药物，如牡丹皮（A错）与泽泻、山药同贮，蛤蚧与花椒、吴茱萸或荜澄茄同贮，蕲蛇或白花蛇与花椒或大蒜瓣同贮，土鳖虫与大蒜同贮，人参与细辛（B错）同贮，冰片与灯心草（D错）同贮，硼砂与绿豆同贮，藏红花与冬虫夏草同贮等。还可采用与具有特殊气味的物质密封同贮，如山苍子油、花椒、樟脑、大蒜、白酒等，有时也可达到良好的防蛀、防霉效果。动物、昆虫类饮片，如乌梢蛇、地龙、蛤蚧等；油脂类中药及炮制品，如柏子仁、桃仁、枣仁等；含糖类饮片，如枸杞子、龙眼肉、黄芪、大枣等；贵重饮片，如冬虫夏草、鹿茸等；含挥发油类饮片，如当归、川芎、瓜蒌等；均可喷洒少量95%药用乙醇或50度左右的白酒密封养护，也可达到良好防蛀、防霉效果。红花（C错）的贮存方法，2022年考试指南未明确说明。